急性肾功能不全少尿期出现高钾血症的主要原因是
A. 钾摄入过多
B. 肾排钾减少
C. 输入过多库存血
D. 分解代谢增强，钾从细胞内溢出
E. 代谢性酸中毒，钾从细胞内溢出

正确答案：B。肾排钾减少

解析：正常人90%的钾离子经肾排泄。急性肾功能不全少尿或无尿时，钾离子排出受限（B对），是高钾血症的主要原因。